一些地方病病区存在两种或两种以上疾病，不是常见的类型的是
A. 高氟与低碘
B. 高氟与低硒
C. 高氟与高砷
D. 低碘与低硒
E. 高氟与高碘

正确答案：E。高氟与高碘

解析：本题考查一些地方病病区存在两种或两种以上疾病的常见类型。一些地方病病区存在两种或两种以上疾病，常见的类型有：高氟与低碘（A对）、高氟与低硒（B对）、高氟与高砷（C对）、低碘与低硒（D对）并存的地质环境。高氟与高碘（E错，为本题正确答案）不是常见的类型。